与100目筛呈对应关系的《中国药典》药筛的筛
A. 一号筛
B. 五号筛
C. 六号筛
D. 七号筛
E. 九号筛

正确答案：C。六号筛

解析：本题考查的是药筛的规格。与100目筛呈对应关系的《中国药典》药筛的筛六号筛（C对）。一号筛（A错）对应10目筛，五号筛（B错）对应80目筛，六号筛对应100目筛，七号筛（D错）对应120目筛，九号筛（E错）对应200目筛。